有关处方药与非处方药的正确描述是
A. 处方药强调品牌，非处方药实行新药保护及专利保护
B. 处方药的宣传对象是消费者（病人），非处方药是医师
C. 处方药宣传可在大众传播媒介，非处方药仅限专业医药报刊
D. 处方药取药需凭执业医师或执业助理医师处方，非处方药则不需要
E. 处方药目录由国家药监部门颁布，非处方药目录则由省级药监部门颁布

正确答案：D。处方药取药需凭执业医师或执业助理医师处方，非处方药则不需要

解析：本题考查处方药与非处方药。处方药取药需凭执业医师或执业助理医师处方，非处方药则不需要（D对）。非处方药是指由国家药品监督管理局公布的，不需要凭执业医师和执业助理医师处方，消费者可以自行判断、购买和使用的药品。处方药是指凭执业医师和执业助理医师处方方可购买、调配和使用的药品。处方药与非处方药均需进行新药保护及专利保护（A错）。处方药只准在专业性医药报刊进行广告宣传，非处方药经审批可以在大众传播媒介进行广告宣传（BC错）。国家药品监督管理局负责处方药与非处方药分类管理办法的制定，国家药品监督管理局负责非处方药目录的遴选、审批、发布和调整工作（E错）。